不属于风湿热的治疗的有
A. 肾上腺皮质激素
B. 卧床休息
C. 肌注青霉素抗链球菌感染
D. 青霉素过敏时可改用红霉素
E. 静脉注射丙种球蛋白

正确答案：E。静脉注射丙种球蛋白

解析：风湿热患者，有心脏受累时应卧床休息，总卧床时间不少于4周，然后逐步恢复活动（B对）。发生心脏炎患者，应使用肾上腺皮质激素治疗，常用泼尼松（A对）。肌注青霉素目的是消除咽部链球菌感染（C对），避免风湿热复发，青霉素过敏时可改用红霉素（D对）。静脉注射丙种球蛋白多用于重度感染及机体免疫系统缺陷时，不用于风湿热的治疗（E错，为本题正确答案）。